男，30岁。肛门周围胀痛伴发热4天。排便时疼痛加重。查体：肛门周围皮肤发红、压痛明显。最可能的诊断是
A. 直肠后间隙脓肿
B. 直肠黏膜下脓肿
C. 骨盆直肠间隙脓肿
D. 肛管括约肌间隙脓肿
E. 肛周皮下脓肿

正确答案：E。肛周皮下脓肿

解析：肛门周围胀痛伴发热，排便时疼痛加重，肛门周围皮肤发红、压痛明显。最可能的诊断是肛周皮下脓肿（E对）。骨盆直肠间隙脓肿（C错）早期就有全身中毒症状，如发热、寒战、全身疲倦不适。局部表现为直肠坠胀感，便意不尽，排便时尤感不适，常伴排尿困难。直肠指诊可在直肠壁上触及肿胀隆起，有压痛和波动感。直肠后间隙脓肿（A错）、直肠黏膜下脓肿（B错）、肛管括约肌间隙脓肿（D错）由于位置较深，局部症状大多不明显，主要表现为会阴、直肠部坠胀感，排便时疼痛加重；病人可伴有不同程度的全身感染症状。直肠指诊可触及痛性肿块。